参加筛查者与不参加筛查者相比可能有更高的受教育程度、个人经济状况更好，因此参加筛查的人群总的发病或死亡风险可能低于不参加筛查人群，导致的偏倚是
A. 领先时间偏倚
B. 病程偏倚
C. 志愿者偏倚
D. 过度诊断偏倚
E. 信息偏倚

正确答案：C。志愿者偏倚

解析：本题考查志愿者偏倚的概念。志愿者偏倚（C对ABDE错）是指健康行为决定筛查意愿，参加筛查者与不参加者相比可能有更高的受教育程度、个人经济状况更好，更关注自身的健康，不良行为习惯的发生率较低，因此参加筛查的人群总的发病或死亡风险可能低于不参加筛查人群。